环境卫生管理内容不包括
A. 环境有毒、有害因素的卫生监测
B. 空气卫生监测
C. 食品卫生监督
D. 工业废水卫生监测
E. 土壤卫生监测

正确答案：C。食品卫生监督